下列药物中，选择性β₁受体阻断药是
A. 阿替洛尔
B. 多巴酚丁胺
C. 异丙肾上腺素
D. 卡维地洛
E. 沙丁胺醇

正确答案：A。阿替洛尔

解析：本题考查阿替洛尔。下列药物中，选择性β₁受体阻断药是阿替洛尔（A对）。阿替洛尔是选择性β₁受体阻断药，用于治疗高血压、心绞痛、心肌梗死，也可用于心律失常、甲状腺机能亢进、嗜铬细胞瘤。多巴酚丁胺（B错）、异丙肾上腺素（C错）为β受体激动药。卡维地洛（D错）兼有α₁和非选择性β受体阻滞作用。沙丁胺醇（E错）为选择性β₂受体激动剂。